以下哪一种不是癌基因产物
A. 生长因子及类似物
B. GTP结合蛋白
C. 生长因子受体
D. 转录因子
E. 酪氨酸蛋白激酶

正确答案：B。GTP结合蛋白